地榆槐角丸既能疏风、润燥，又能
A. 凉血，泻热
B. 凉血，息风
C. 凉血，祛湿
D. 凉血，活血
E. 凉血，排脓

正确答案：A。凉血，泻热

解析：本题考查的是地榆槐角丸的功能。地榆槐角丸既能疏风、润燥，又凉血，泻热（A对）。地榆槐角丸：【功能】疏风凉血，泻热润燥。羚羊角：【功效】平肝息风，清肝明目，凉血（B错）解毒。紫草：【功效】凉血活血（D错），解毒透疹。功能为凉血，祛湿（C错）或凉血，排脓（E错）的中成药，2022年考试指南未明确说明。